正确确定垂直距离，下列哪一项是错误的
A. 面部和谐，肌张力正常
B. 充分发挥咀嚼肌的力量
C. 防止颞颌关节病变
D. 防止咬舌、咬颊
E. 防止牙槽骨吸收

正确答案：D。防止咬舌、咬颊

解析：本题考查正确确定垂直距离的意义。垂直距离正确恢复与否和防止咬舌、咬颊（D错，为本题的正确答案）并无关联，一般来说，咬舌、咬颊与排牙时所恢复的覆盖有关，若覆盖恢复过小，则易引起咬舌、咬颊。垂直距离是自然牙列呈正中（牙合）时，鼻底至颏底的距离，也就是面下1/3的距离。正确恢复垂直距离有助于使患者恢复至缺牙前时口腔的状态，有利于面部和谐，肌张力正常（A对）。正确的垂直距离加上合适的排牙可使牙列达到尖窝交错的最佳状态，有助于充分发挥咀嚼肌的力量（B对），提高咀嚼效率，同时也可降低颞下颌关节的负荷，防止颞颌关节病变（C对）。若垂直距离恢复过大，可使义齿高度增加，导致肌肉张力增大，时间长了会使牙槽骨长时间处于受压状态，最终导致牙槽骨的吸收，因此正确恢复垂直距离可有效防止牙槽骨吸收（E对）。